女，25岁。发现心悸、盗汗、易怒1年，伴有饮食量增加及消瘦。查体：BP110/80mmHg，重度突眼，甲状腺弥漫性肿大，深入胸骨后上纵隔内，心率116次/分。测血T₃、T₄值高于参考值上限一倍。对患者应尽早手术治疗，其适应症是
A. TSH增高
B. T₃、T₄值显著升高
C. 甲状腺弥漫性肿大
D. 甲状腺位于胸骨后
E. 重度眼突

正确答案：D。甲状腺位于胸骨后

解析：甲状腺位于胸骨后（D对）为甲状腺大部切除术的适应证。系因胸骨后甲状腺肿可压迫气管，导致呼吸困难；压迫食管，引起吞咽不适感；压迫颈深部大静脉，引起头颈部血液回流困难，导致面部青紫色浮肿，颈部及胸前表浅静脉明显扩张。T3、T4值显著升高（B错）为甲亢的一般表现，不是手术适应证。甲亢时，血浆中升高的甲状腺激素可反馈性抑制腺垂体分泌TSH，导致血TSH降低（A错）。甲状腺弥漫性肿大（C错）不是手术适应证，甲状腺弥漫性肿大伴有压迫症状是手术适应证。甲亢突眼（E错）由甲亢时抗原-抗体复合物在球后组织沉积导致，甲状腺手术不仅不能解决突眼症状，甚至能导致突眼程度加重，故重度突眼者不宜手术治疗。